能润肺止咳作用的有
A. 百部
B. 白果
C. 紫菀
D. 洋金花
E. 马兜铃

正确答案：A、C。百部；紫菀

解析：本题考查的是百部与紫菀的功效。能润肺止咳作用的有百部（A对）与紫菀（C对）。百部：【功效】润肺止咳，杀虫灭虱。紫菀：【功效】润肺下气，化痰止咳。白果（B错）：【功效】敛肺平喘，止带缩尿。洋金花（D错）：【功效】平喘止咳，解痉，定痛。马兜铃（E错）：【功效】清肺化痰，止咳平喘，清肠疗痔。